良性前列腺增生症老年患者，应用α₁肾上腺素能受体阻断剂治疗时可能导致的不良反应是
A. 体位性低血压
B. 尿潴留
C. 干咳
D. 乳腺增生
E. 前列腺特异性抗原（PSA）水平升高

正确答案：A。体位性低血压

解析：本题考查药物不良反应。抗前列腺增生药物，α肾上腺素能受体阻断剂的主要不良反应是可引起直立性低血压（即体位性低血压）（A对）、眩晕、头痛、困倦、逆向射精等。